关于非参数检验，以下错误的一项是
A. 适用于非正态分布资料
B. 适用于分布类型未知的资料
C. 若是正态分布资料，非参数检验犯第Ⅱ类错误的概率增大
D. 若是正态分布资料，非参数检验的检验效率降低
E. 若是正态分布资料，非参数检验的检验效率不变

正确答案：E。若是正态分布资料，非参数检验的检验效率不变